女，23岁。1个月前分娩后出现失眠、心情烦躁，近2周加重，认为自己很笨，没有能力带好小孩，怕小孩夭折，觉得丈夫不再喜欢自己了，猜疑丈夫有外遇，整日以泪洗面，称不想活了，甚至要带孩子一起去死，遂入院治疗。患者经治疗后，情况逐渐好转，近1周显兴奋，容易激动，好管闲事，自我感觉良好，称将来要成为中国女首富，丈夫根本配不上自己。目前可换用的治疗方案是
A. 非典型抗精神病药+抗抑郁药物
B. 抗抑郁药物+苯二氮䓬类药物
C. 电抽搐治疗+抗抑郁药物
D. 心境稳定剂+非典型抗精神病药
E. 心境稳定剂+抗抑郁药物

正确答案：D。心境稳定剂+非典型抗精神病药

解析：各类躁狂发作均以药物治疗为主，特殊情况下可选用电抽搐或改良电抽搐治疗。药物治疗：以心境稳定剂为主（ABC错）。双相躁狂发作使用抗抑郁药物会加重躁狂症状（E错）。临床证据显示，其他抗癫痫药、第二代抗精神病药物，也觉有一定的心境稳定作用，可作为候选的心境稳定剂使用（D对）。